链球菌属直径大小约为
A. 0.2～0.4μm
B. 0.4～0.6μm
C. 0.6～0.8μm
D. 0.6～1.0μm
E. 1.0～1.2μm

正确答案：D。0.6～1.0μm

解析：链球菌属形态和染色：革兰氏染色为阳性，直径0.6～1.0μm，呈链状排列，无鞭毛，不形成芽胞，幼龄菌可有透明质酸形成的荚膜。掌握“链球菌属”知识点。